卫气的主要生理功能有
A. 护卫肌表
B. 固摄血液
C. 防御外邪入侵
D. 调节汗孔开合
E. 营养脏腑经络

正确答案：A、C、D。护卫肌表；防御外邪入侵；调节汗孔开合

解析：本题考查的是卫气的生理功能。卫气的主要生理功能有护卫肌表（A对）、防御外邪入侵（C对）与控制汗孔开合（D对）。卫气：与营气相对而言，卫气行于脉外而属阳，又称“卫阳”。卫气主要由水谷精气所化生，运行于脉外。卫气活动力特别强，流动迅速，故不受脉管的约束，可运行于皮肤、分肉之间，布散于全身内外上下。卫气的生理功能有三个方面：一是护卫肌表，防御外邪入侵；二是温养脏腑、肌肉、皮毛等；三是调节控制汗孔的开合和汗液的排泄，以维持体温的相对恒定。所以，人体卫外功能的强弱，以及能否维持体温的相对恒定，同卫气的功能活动是否正常有着密切关系。固摄血液（B错）为指气的固摄功能。气的固摄作用：气的固摄作用，主要是对于精、血、津液等物质具有防止其无故流失，以及维护脏腑器官各自位置的相对恒定等作用。具体表现在：固摄血液，即维持血液在脉管内循行，防止逸出脉外；固摄汗液、尿液、唾液、胃液、肠液等正常物质分泌和排泄，防止其无故外泄和流失，从而维持体内水液代谢的相对平衡；维持脏腑器官位置的稳定，使之保持正常的生理活动和脏腑之间功能的相互协调，维持胎儿在胞宫内的安定和正常发育等。营养脏腑经络（E错）为营气的生理功能。营气：又称“荣气”，与卫气相对而言，营气行于脉内而属阴，故又有“营阴”之称。主要来源于脾胃所运化的水谷精气，由水谷精气中的精华部分所化生。水谷精微中的精华部分，是营气的主要成分，是脏腑、经络等生理活动的主要营养物质。营气的生理功能：有营养人体和化生血液两方面。营气运行于全身血脉之中，成为血液的重要组成部分。故营气与血液的关系极为密切，可分而不可离，故常以“营血”并称。